某女，36岁。素患赤白带下，又见湿热泻痢。宜选用的中药是
A. 金樱子
B. 桑螵蛸
C. 椿皮
D. 海螵蛸
E. 石榴皮

正确答案：C。椿皮

解析：本题考查椿皮的主治病证。宜选用的中药是椿皮（C对）。椿皮【主治病证】（1）久泻久痢，湿热泻痢，便血。（2）崩漏，赤白带下。（3）蛔虫病。（4）疮癣作痒。金樱子（A错）【主治病证】（1）遗精滑精，尿频遗尿。（2）久泻久痢。（3）崩漏带下。桑螵蛸（B错）【主治病证】（1）肾阳亏虚之遗精、滑精，遗尿、尿频，小便白浊，带下。（2）阳痿不育。海螵蛸（D错）【主治病证】（1）崩漏下血，肺胃出血，创伤出血。（2）肾虚遗精，赤白带下。（3）胃痛吞酸。（4）湿疮湿疹，溃疡不敛。石榴皮（E错）【主治病证】（1）久泻久痢。（2）便血，崩漏。（3）虫积腹痛。